目前我国的国际监测传染病包括
A. 鼠疫、流行性斑疹伤寒、回归热
B. 鼠疫、回归热、疟疾、流行性斑疹伤寒、霍乱
C. 流行性感冒、脊髓灰质炎、疟疾、流行性斑疹伤寒、回归热、登革热
D. 脊髓灰质炎、流行性感冒、流行性斑疹伤寒、回归热、黄热病
E. 鼠疫、霍乱、黄热病、流行性感冒、回归热、疟疾

正确答案：C。流行性感冒、脊髓灰质炎、疟疾、流行性斑疹伤寒、回归热、登革热

解析：本题考查目前我国的国际监测传染病。WHO规定的国际监测传染病为流行性感冒、脊髓灰质炎、疟疾、流行性斑疹伤寒和回归热等5种，我国根据国情增加了登革热（C对ABDE错）。